目的视觉功能主要取决于
A. 肾中精气的充盈
B. 肝血的充足
C. 脾气的健运
D. 肾阳的蒸化
E. 肾阴的滋养

正确答案：B。肝血的充足

解析：肾中的精气充盈则肾气充足，与人体的生长发育和生殖相关（A错）。目为人体的视觉器官，而肝上连目系，故其功能与肝直接相关，肝血对目有重要的滋养作用肝血充足，肝气调和，目才能正常发挥其视物辨色的功能（B对）。脾气的健运与脾运化输布水谷精微和水液有关（C错）。肾阳的蒸腾作用即肾阳对其他脏腑乃至全身具有重要的温煦作用（D错）。肾阴的滋润作用即肾阴对其他脏腑乃至全身具有重要的滋润作用（E错）。